具有焦耳-汤姆逊冷却效应，适用于热敏性物料的粉碎设备
A. 球磨机
B. 气流式粉碎机
C. V型混合机
D. 冲击式粉碎机
E. 胶体磨

正确答案：B。气流式粉碎机